螺旋器位于
A. 蜗管
B. 椭圆囊
C. 咽鼓管
D. 膜半规管
E. 球囊

正确答案：A。蜗管

解析：耳蜗是感音装置所在部位，在耳蜗的横断面上，可见其被两个膜（前庭膜和基底膜）分为三个腔（三个腔分别称为前庭阶、蜗管和鼓阶）。其中螺旋器位于蜗管（A对）的基底膜上，因基底膜自蜗底一直延伸到蜗顶呈螺旋状而得其名。